女，18岁，某大学一年级新生。入学后对新的学习环境和教学模式不适应，出现情绪焦虑、失眠等情况。该生的辅导员、老师及同学们给予其热情的帮助疏导和安慰，使该生逐渐走出适应不良的状态。这种应对应激的方法属于
A. 回避应激源
B. 催眠心理治疗
C. 专业思想教育
D. 运用自我防御机制
E. 取得社会支持

正确答案：E。取得社会支持

解析：行为性应激反应包括积极及消极的行为应对反应。积极的行为性应激可为患者减少压力，甚至可以激发主体的能动性，激励主体克服困难，战胜挫折。而消极的行为性应激则会使个体出现回避、退缩等行为。积极的行为应激反应包括问题解决策略及情绪缓解策略。前者发挥主观能动性改变不利环境，后者改变自己对事件的情绪反应强度。问题解决策略包括①寻求社会支持：拥有的好的社会支持常常会带来很多资源和能量。②获得解决问题需要的信息：全面了解应激源，正确认识压力，了解解决问题的方法，获得更多的选择。③制定解决问题需要的计划：制定计划，并实施计划。④面对问题，找到切入点：直面问题，直面应激源，能动的适应并改造境遇。该生面对新环境适应不良，产生焦虑等症状，辅导员和同学进行热情的帮助，使该生走出适应不良的状态，这是问题解决策略，属于典型的取得社会支持（E对）。情绪缓解策略包括①宣泄情绪：向他人表达自己的情绪。②改善认知：评估事件，了解哪些是可以改变的，而哪些又是需要接受的，改变对事物的期待。③行为放松训练：放松训练、瑜伽、观呼吸法、冥想等 都是积极的应对策略。④回避问题：避开可以引起痛苦回忆的人或事，回避困难。消极性行为应激反应包括逃避与回避（A错）、退化与依赖、敌对与攻击、无助与自怜、物质滥用。题中并没有涉及催眠心理治疗（B错）和专业思想教育（C错），该生也并不是自主运用自我防御机制（D错）。